男，25岁。于8月份突然发病，发冷，寒战、高热、大汗，隔日发作已服氯喹控制，血涂片查到疟原虫。经氯喹治疗后病情缓解。为防止复发，应联合应用的药物是
A. 乙胺嘧啶
B. 奎宁
C. 青蒿素
D. 伯氨喹
E. 甲氟喹

正确答案：D。伯氨喹

解析：在疟疾治疗时需分别用杀灭红细胞内疟原虫的药物和杀灭红细胞内疟原虫配子体和迟发型子孢子的药物，首先必须先应用一种杀灭红细胞内疟原虫的药物如氯喹、青蒿素（C错）、甲氟喹（E错）等，经治疗后病情缓解，为防止复发，再联合应用杀灭红细胞内疟原虫配子体和迟发型子孢子的药物如伯氨喹（D对）。乙胺嘧啶（A错）是抗叶酸类药物，主要用于与其他药物联合治疗。奎宁（B错）主要用于耐氯喹疟原虫株感染患者。